女，30岁，初产妇，未临产。妊娠35周，恶心、呕吐、乏力伴皮肤黄染、瘙痒1周。结合化验检查诊断为妊娠合并乙型病毒性肝炎（重型），除保肝治疗外，应采取的措施
A. 尽快使用子宫动脉栓塞术
B. 尽快行剖宫产术
C. 尽快催产素促进宫颈成熟
D. 继续妊娠至37周
E. 尽快利凡诺尔腔内引产

正确答案：B。尽快行剖宫产术

解析：患者诊断为妊娠合并乙型病毒性肝炎（重型），应以积极保肝、对症支持、防治并发症、防治感染等治疗稳定病情，待凝血功能、白蛋白、胆红素、转氨酶等重要指标改善24小时左右迅速终止妊娠（D错），因母儿耐受力差，过度消耗可加重肝脏负担，分娩方式应选择剖宫产术（B对E错）。子宫动脉栓塞术（A错）为宫缩乏力引起产后出血的处理措施之一。地西泮促进宫颈成熟（C错）多用于高龄产妇宫颈成熟不良者。